对病人不一定有助益，可能违背医学伦理学有利原则的做法是
A. 根据病情作相应检查
B. 根据病情作相应治疗
C. 根据病情给予止痛手段
D. 病人受益而不给他人伤害
E. 病人患癌症而到了晚期时告知他本人

正确答案：E。病人患癌症而到了晚期时告知他本人

解析：为使医务人员的行为对患者确有助益，要求：①医务人员的行为要与解除患者的痛苦有关；②医务人员的行为可能减轻或解除患者的痛苦；③医务人员的行为对患者利害共存时，要使行为给患者带来最大的益处和最小的危害；④医务人员的行为使患者受益而不会给他人带来太大的伤害等。掌握“医学伦理的基本原则”知识点。